中结肠动脉行经于
A. 乙状结肠系膜内
B. 回肠系膜内
C. 空肠系膜内
D. 横结肠系膜内
E. 盲肠系膜内

正确答案：D。横结肠系膜内

解析：横结肠系膜内（D对）有中结肠动脉经过，中结肠动脉在胰下缘的附近起于肠系膜上动脉。